痢疾杆菌的主要致病机制是
A. 侵入的细菌数量
B. 外毒素
C. 神经毒素
D. 侵袭力和内毒素
E. 肠毒素

正确答案：D。侵袭力和内毒素

解析：痢疾杆菌进入人体后是否发病取决于对肠黏膜上皮细胞的吸附和侵袭力，即具有侵袭力的菌株才会引起发病。痢疾杆菌对肠黏膜上皮细胞的侵袭力是决定其致病的主要因素；痢疾杆菌可产生内、外两种毒素，内毒素可增高肠壁的通透性，进一步促进毒素的吸收，引起恶寒、发热等毒血症状（D对）。